在氢氧化钠溶液中，与硫酸铜试液反应，生成草绿色沉淀
A. 异烟肼
B. 肾上腺素
C. 苯巴比妥
D. 盐酸利多卡因
E. 磺胺甲噁唑

正确答案：E。磺胺甲噁唑

解析：本题考查磺胺甲噁唑的鉴别。磺胺甲噁唑（E对）的鉴别：（1）用氢氧化钠溶液溶解后与硫酸铜反应，即生成草绿色沉淀；（2）红外光吸收图谱法；（3）芳香第一胺类反应。